按照甲类传染病管理的乙类传染病是
A. 猩红热
B. 艾滋病
C. 登革热
D. 霍乱
E. 肺炭疽

正确答案：E。肺炭疽

解析：法定传染病分为甲、乙、丙三类。乙类包括猩红热、艾滋病、登革热、脊髓灰质炎、肺炭疽5种疾病在内的27种疾病，其中按照甲类传染病管理的乙类传染病是传染性非典型性肺炎、炭疽中的肺炭疽（E对）、人感染高致病性禽流感和脊髓灰质炎。